属于镇静安眠药的是
A. 地西泮
B. 吲哚美辛
C. 硝酸甘油
D. 胺碘酮
E. 阿米卡星

正确答案：A。地西泮

解析：本题考查镇静催眠药地西泮。地西泮（A对）为长效苯二氮䓬类镇静催眠药；吲哚美辛（B错）属于芳基乙酸类非甾体抗炎药；硝酸甘油（C错）为硝酸酯类抗心绞痛药；胺碘酮（D错）临床适用于房性心律失常、室性心律失常、结性心律失常、伴有预激综合征的心律失常等；阿米卡星（E错）为氨基糖苷类抗菌药物，抗菌谱和庆大霉素相似，适用于铜绿假单胞菌。